急性DIC患者不可能出现下列哪项结果
A. 血小板计数减少
B. 纤维蛋白降解产物浓度增高
C. 凝血酶时间明显延长
D. 纤维蛋白原浓度增加
E. 凝血酶原时间延长

正确答案：D。纤维蛋白原浓度增加

解析：纤维蛋白原浓度增加（D错，为本题正确答案）常见于慢性DIC 或恢复期DIC,不可能出现在急性DIC患者。血小板计数减少（A对）、纤维蛋白降解产物浓度增高（B对）、凝血酶时间明显延长（C对）和凝血酶原时间延长（E对）出现在急性DIC中。